可用于阿片类成瘾替代治疗的氨基酮类药物是
A. 氟西汀
B. 艾司佐匹克隆
C. 艾司唑仑
D. 齐拉西酮
E. 美沙酮

正确答案：E。美沙酮

解析：本题考查氨基酮类镇痛药。可用于阿片类成瘾替代治疗的氨基酮类药物是美沙酮（E对）。美沙酮为阿片受体激动剂，镇痛效果比吗啡、哌替啶强，其左旋体镇痛作用比右旋体强20倍。适用于各种剧烈疼痛，并有显著镇咳作用，毒性较大，有效剂量与中毒剂量比较接近，安全度小，但成瘾性较小，临床上主要用于海洛因成瘾的戒除治疗（脱瘾疗法）。氟西汀（A错）属于选择性5-羟色胺再摄取抑制药，用于抗抑郁症、强迫症、恐怖症和暴食症等。艾司佐匹克隆（B错）为非苯二氮䓬类镇静催眠药，用于入睡困难、夜间维持睡眠困难、早醒等不同类型的睡眠障碍。艾司唑仑（C错）为苯二氮䓬类镇静催眠药，主要用于抗焦虑、失眠；也用于紧张、恐惧及抗癫病和抗惊厥。齐拉西酮（D错）为是运用拼合原理设计的非经典抗精神病药。